具有理气调中，燥湿化痰功效的药物是
A. 橘皮
B. 青皮
C. 枳实
D. 木香
E. 香附

正确答案：A。橘皮

解析：橘皮的功效是理气健脾，燥湿化痰；橘皮辛香走窜，温通苦燥，入脾胃经，有行气、除胀、燥湿之功，故为治脾胃气滞、湿阻之脘腹胀满、食少吐泻之佳品，对寒湿阻滞中焦者，最为适宜；性味苦温，长于燥湿化痰，又能理气宽胸，为治湿痰、寒痰之要药（A对）。青皮（B错）的功效是疏肝破气，消积化滞。枳实（C错）的功效是破气消积，化痰散痞。木香（D错）的功效是行气止痛，健脾消食。香附（E错）的功效是疏肝解郁，理气宽中，调经止痛。